急性痛风性关节炎的主要临床特点不包括
A. 秋水仙碱治疗可迅速缓解关节炎症状
B. 常伴高尿酸血症
C. 单侧第一掌指关节肿痛最为常见
D. 在偏振光显微镜下，关节液内发现呈双折光的针形尿酸结晶
E. 疼痛剧烈，初次发作常呈自限性

正确答案：C。单侧第一掌指关节肿痛最为常见

解析：痛风是单钠尿酸盐沉积于骨关节、肾脏和皮下等部位，引发的急、慢性炎症和组织损伤。急性痛风性关节炎关节疼痛剧烈，初次发作常呈自限性（E对），常伴高尿酸血症（B对），受累关节于单侧第1跖趾关节最常见（C错，为本题正确答案）。在偏振光显微镜下，关节液内发现呈双折光的针形尿酸结晶（D对）为确诊本病的依据。秋水仙碱可抑制中性粒细胞、单核细胞释放白三烯B4、糖蛋白化学趋化因子、白细胞介素-1等炎症因子，同时抑制炎症细胞的变形和趋化，可迅速缓解关节炎症状（A对）。